下课铃一响，几个校篮球队员便迫不及待地跑到操场上，分成两组，打起篮球。没打几分钟，周亮跳起投球，落地时摔倒了。好不容易站起来，右脚却不能动了，而且很痛。首先应该采取的处理措施是
A. 按摩
B. 关节复位
C. 热敷
D. 冷敷
E. 固定

正确答案：D。冷敷